某女，30岁。患瘰疬2年，症见皮下结块、不热不痛。医师处以内消瘰疬丸，此因该中成药的功能是
A. 活血，通络，定痛
B. 清热，活血，化瘀
C. 化痰，软坚，散结
D. 祛腐，散结，生肌
E. 收湿，消肿，止痛

正确答案：C。化痰，软坚，散结

解析：本题考查的是内消瘰疬丸的功能。患瘰疬2年，症见皮下结块、不热不痛。医师处以内消瘰疬丸，此因该中成药的功能是化痰，软坚，散结（C对）。内消瘰疬丸：【功能】化痰，软坚，散结。痛风定胶囊：【功能】清热祛湿，活血通络定痛（A错）。当归苦参丸：【功能】活血化瘀，燥湿清热（B错）。功能为祛腐，散结，生肌（C错）或收湿，消肿，止痛（E错）的中成药，2022年考试指南未明确说明。